具有消痰行水，降气止呕功效的药物是
A. 款冬花
B. 旋覆花
C. 川贝母
D. 代赭石
E. 天南星

正确答案：B。旋覆花

解析：旋覆花的功效是降气，消痰，行气，止呕（B对）。款冬花（A错）的功效是润肺下气，止咳化痰。川贝母（C错）的功效是清热润肺，化痰止咳，散结消痈。代赭石（D错）的功效是平肝潜阳，重镇降逆，凉血止血。天南星（E错）的功效是燥湿化痰，祛风止痉，散结消肿。